关于慢性增生性牙髓炎的临床表现，以下说法正确的是
A. 有明显疼痛
B. 进食疼痛明显
C. 温度刺激敏感
D. 增生的牙髓呈现暗红色或粉红色
E. 探痛明显

正确答案：D。增生的牙髓呈现暗红色或粉红色

解析：本题考查慢性增生性牙髓炎的临床表现。关于慢性增生性牙髓炎的临床表现，以下说法正确的是增生的牙髓呈现暗红色或粉红色（D对）。慢性增生性牙髓炎多无明显疼痛症状。增生的牙髓呈暗红色或粉红色，自龋洞突向口腔，牙髓息肉米粒大小或充满整个龋洞。进食时易出血或有轻微疼痛，对温度刺激表现为钝痛。由于增生的牙髓组织中神经纤维少，对刺激不敏感，探痛不明显。